患者体质素弱，近半年来呕吐时作时止，倦怠乏力，舌苔薄白，脉弱治疗除主穴外，应选用
A. 期门太冲
B. 脾俞神阙
C. 丰隆公孙
D. 上脘胃俞
E. 梁门天枢

正确答案：B。脾俞神阙

解析：患者素体虚弱，呕吐时作时止，倦怠乏力，舌苔薄白，脉弱，一派虚弱之象，证属呕吐之脾胃虚寒证，治宜温中健脾，和胃降逆。主穴选用中脘、胃俞、内关和足三里，可配脾俞、神阙（B对）。若肝气犯胃可配期门太冲（A错）；痰饮内停可配丰隆公孙（C错）；吐剧可配上脘胃俞（D错）；饮食停滞可配梁门天枢（E错）。